女性，55岁，为慢性阻塞性肺疾病（COPD）气肿型患者。近年来轻微活动即感气急，咳嗽轻，咳痰少。血气分析：PaO₂9.3kPa（70mmHg），PaCO₂4.8kPa（36mmHg）。根据血气分析结果，该患者的呼吸功能障碍为
A. 通气功能障碍
B. 换气功能障碍
C. 通气和换气功能障碍并存
D. 肺泡膜增厚所致弥散功能降低
E. 通气/血流比例降低

正确答案：B。换气功能障碍

解析：患者中老年女性，为慢性阻塞性肺疾病（COPD）气肿型患者。近年来轻微活动即感气急，咳嗽轻，咳痰少。血气分析：PaO₂ 9.3kPa（70mmHg）（正常值PaO₂80～100mmHg，提示轻度低氧血症），PaCO₂4.8kPa（36mmHg）（正常值PaCO₂35～45mmHg）。结合患者血气分析，考虑诊断为轻度低氧血症，低氧血症多存在换气功能障碍（B对），且慢性阻塞性肺疾病（COPD）患者往往有换气功能障碍。COPD患者肺泡间血流量减少，此时肺泡虽有通气，但肺泡壁无血液灌流，导致无效腔增大；也有部分肺区虽有血液灌流，但肺泡通气不良，不能参与气体交换，导致功能性分流增加，从而通气/血流比例失调，并非单纯通气/血流比例降低（E错）。换气功能障碍的弥散功能损害，多因肺泡及毛细血管大量丧失，弥散面积减少，不是肺泡膜增厚所致弥散功能降低（D错）。通气功能障碍（A错）时低氧血症和高碳酸血症的程度是平行的，多为Ⅱ型呼吸衰竭；通气和换气功能障碍并存（C错）表现为同时低氧血症和高碳酸血症，但低氧血症更为严重。